肠梗阻时，呕吐物多为
A. 含血液
B. 隔夜食物
C. 大量粘液
D. 咖啡色
E. 黄绿色稀薄液

正确答案：B。隔夜食物

解析：呕吐是通过胃的强烈收缩迫使胃或部分小肠内容物经食管、口腔而排出体外的现象。肠梗阻时，呕吐物多为隔夜食物（B对）。呕吐物含血液（A错）可见于食管胃底静脉曲张破裂出血。呕吐物含大量粘液（C错）可见于多种胃肠道疾病，特异性不高。呕吐物呈咖啡色（D错）可见于上消化道出血。呕吐物含黄绿色稀薄液（E错）也可见于低位肠梗阻，但较隔夜食物少见。